以下的观念中不正确的是
A. 人可以终生拥有一副完整牙齿
B. 糖类可促进龋病的发生
C. 人老掉牙
D. 牙周病可致牙齿松动
E. 根尖周炎可见牙龈的瘘管

正确答案：C。人老掉牙

解析：人老掉牙不是必然规律，大多是由于长期患有龋病、牙周病等口腔疾病造成的。只要预防和及时治疗口腔疾病，养成良好的口腔卫生习惯，掌握科学的口腔保健方法，就可终生拥有一副健康的牙齿。掌握“老年人口腔保健”知识点。